山药的特征为
A. 药材断面白色，粉性
B. 药材横断面可见黄色小孔呈放射状排列
C. 二者均是
D. 二者均非

正确答案：A。药材断面白色，粉性

解析：本题考查的是山药药材的性状鉴别。山药的特征为药材断面白色，粉性（A对）。山药：【性状鉴别】药材毛山药略呈圆柱形，弯曲而稍扁。表面黄白色或淡黄色，有纵沟、纵皱纹及须根痕，偶有浅棕色的外皮残留。体重，质坚实，不易折断，断面白色，粉性。气微，味淡，微酸，嚼之发黏。药材横断面可见黄色小孔呈放射状排列（B错）为天花粉药材的鉴别特征。天花粉：【性状鉴别】药材呈不规则圆柱形、纺锤形或瓣块状。表面黄白色或淡棕黄色，有纵皱纹、细根痕及略凹陷的横长的皮孔；有的有黄棕色外皮残留。质坚实，断面白色或淡黄白色，富粉性，横切面可见黄色小孔（导管），略呈放射状排列，纵切面可见黄色条纹状木质部。气微，味微苦。